与阿莫西林配伍，可提高治疗的是
A. 叶酸
B. 苄丝肼
C. 克拉维酸钾
D. 奥美拉唑
E. 维生素C

正确答案：C。克拉维酸钾

解析：本题考查药物的联合应用。与阿莫西林配伍，可提高治疗的是克拉维酸钾（C对）。阿莫西林易被细菌的β内酰胺酶水解，克拉维酸是β内酰胺酶不可逆的竞争型抑制剂，阿莫西林与克拉维酸组成复方制剂阿莫西林克拉维酸钾，可保护不耐酶的抗菌药物结构，提高抗菌活性和效果。叶酸（A错）用于治疗巨幼细胞性贫血。苄丝肼（B错）与左旋多巴合用可增强左旋多巴的药效。奥美拉唑（D错）属于质子泵拮抗剂。维生素C（E错）可以促进硫酸亚铁吸收。